骨度分寸规定，髀枢至膝中的距离是
A. 13寸
B. 14寸
C. 16寸
D. 18寸
E. 19寸

正确答案：E。19寸

解析：本题考查重要的骨度分寸定位规定。髀枢至膝中的距离为19寸（E对）。其他选项不合题意（ABCD错）。